心源性脑栓塞时，栓塞多发生在
A. 大脑前动脉
B. 大脑中动脉
C. 大脑后动脉
D. 椎动脉
E. 基底动脉

正确答案：B。大脑中动脉

解析：心源性脑栓塞时，栓塞多发生在大脑中动脉（D对），约占80%，但大脑前动脉（A错）很少发生脑栓塞；约20%心源性脑栓塞见于椎－基底动脉（D错）系统，其中基底动脉尖部（E错）和大脑后动脉（C错）较多见。